替咨询者保守个人和家庭隐私，遵循了心理咨询的哪条原则
A. 保密的原则
B. 限时的原则
C. 自愿的原则
D. 情感自限的原则
E. 延期决定的原则

正确答案：A。保密的原则